Arbor临床分期标准，该患者临床分期是
A. ⅡEB
B. ⅢSB
C. ⅢA
D. ⅡB
E. ⅢEB

正确答案：B。ⅢSB

解析：患者青年男性，双侧颈部淋巴结肿大伴发热1周，淋巴结活检诊断为霍奇金淋巴瘤，查体：颈部及右侧腹股沟区可触及数枚肿大淋巴结，肝肋下未触及，脾肋下2cm（Ⅲ期：横膈上下淋巴结区域同时受侵犯，可伴有局灶性相关结外器官（ⅢE）、脾受侵犯（ⅢS）或两者皆有（ⅢE+S）），患者淋巴结肿大累及横膈上下，同时伴有脾脏受累，提示为ⅢS期；患者有发热，体温38.4℃（1.不明原因发热大于38℃；2.盗汗；3.半年内体重下降10%以上，出现其中一项即可分为B组），提示为B组，综合分析患者临床分期是ⅢSB期。